1岁小儿未接种过卡介苗，PPD阳性表示
A. 近2～3周感染结核
B. 体内已有免疫力，不会再感染结核
C. 体内有活动结核
D. 对结核无免疫力，需立即接种卡介苗
E. 受过结核感染，不一定有活动结核

正确答案：C。体内有活动结核

解析：未接种过卡介苗的小儿PPD阳性提示体内有新的结核病灶，年龄越小活动性结核可能性越大（C对）。结核菌感染机体后需要4-8周建立变态反应，在这期间PPD反应可呈假阴性，因此若被检患儿出现PPD阳性至少要在其受结核感染后4-8周（A错）。已经患结核的小儿不宜再注射卡介苗（D错）。